本身无活性，需经肝脏代谢转化为活性产物面发挥COX-2抑制作用的药物是
A. 吲哚美辛
B. 双氯芬酸钠
C. 萘普生
D. 萘丁美酮
E. 布洛芬

正确答案：D。萘丁美酮

解析：本题考查萘丁美酮的性质。萘丁美酮（D对）口服后以非酸性前体药物在十二指肠被吸收，经肝脏转化为主要活性产物6-甲氧基-2-萘乙酸，从而对COX-2可产生选择性的抑制作用。